青春期心理特点不包括
A. 性困惑
B. 半成熟、半幼稚
C. 青春期幻想
D. 独立性增强
E. 不受同伴影响

正确答案：E。不受同伴影响

解析：本题考查青春期的心理特点。青春期是个性心理发生剧烈变化的时期。心理特征既具有童年的痕迹，又有成年人成熟心理的萌发，常表现为情绪不稳定，半成熟、半幼稚（B对）；求知欲和好奇心强烈，产生性困惑（A对），出现青春期幻想（C对）；独立性较儿童期增强（D对），但易受同伴影响（E错，为本题正确答案）。